能引起骨髓造血系统抑制和再生障碍性贫血的药物是
A. 氨苄青霉素
B. 甲氧苄啶
C. 利多卡因
D. 氯霉素
E. 哌替啶

正确答案：D。氯霉素

解析：本题考查氯霉素。氯霉素（D对）能够引起严重骨髓抑制、再生障碍性贫血及灰婴综合征。氨苄西林（A错）容易引起过敏反应。甲氧苄啶（B错）不良反应为胃肠道反应和过敏反应。利多卡因（C错）不良反应为视神经炎和过敏反应。杜冷丁（E错）毒副作用较小，恶心、呕吐、便秘等症状均较轻微，对呼吸系统的抑制作用较弱。